仅具有幻觉、妄想或明显的精神运动兴奋或意志等“精神病性症状”的精神障碍，称为
A. 精神病
B. 神经病
C. 心身疾病
D. 妄想症
E. 精神分裂症

正确答案：A。精神病

解析：精神病特指具有幻觉、妄想或明显的精神运动兴奋或抑制等“精神病性症状”的精神障碍，只是精神障碍中的一小部分。掌握“精神障碍概述”知识点。